62岁女性，因腮腺长期肿块，近期喝汤外漏前来就诊。检查发现左侧腮腺实性肿块，活动性好，左侧面瘫，有疼痛感。术中病理切片可见肿瘤实质中有腺泡样细胞、闰管样细胞、空泡样细胞、透明细胞和非特异性腺样细胞。则下列哪项不是此肿瘤细胞的排列类型
A. 实体型
B. 微囊型
C. 滤泡型
D. 网状型
E. 乳头囊状型

正确答案：D。网状型

解析：根据病人的临床表现和术中切片见到组织细胞可判断此病为腺泡细胞癌。腺泡细胞癌多见于腮腺，多数肿瘤生长缓慢，实质性，活动；可出现疼痛、面瘫症状。镜下见肿瘤实质细胞有腺泡样细胞、闰管样细胞、空泡样细胞、透明细胞和非特异性腺样细胞。肿瘤细胞排列为四种组织类型：实体型、微囊型、滤泡型、乳头囊状型。掌握“腺泡细胞癌”知识点。